风湿性心脏瓣膜病的中医病因病机是
A. 寒邪内侵，饮食不节，情志失调
B. 正气虚弱，外邪侵袭，心血瘀阻
C. 情志失调，寒邪内侵，饮食不节，久病过劳
D. 先天禀赋不足，寒邪内侵，饮食不节，情志失调，年迈体衰
E. 寒邪内侵，饮食不节，情志失调，年迈体衰，痰湿内蕴

正确答案：B。正气虚弱，外邪侵袭，心血瘀阻

解析：风湿性心脏瓣膜病的病机为正虚邪入，痹阻心脉，病属本虚标实，虚指气血阴阳亏虚，实以瘀血、水饮为主（B对）。寒邪内侵，饮食不节，情志失调是冠心病心绞痛的一部分病因，风湿性心脏瓣膜病多为虚证（A错）。情志失调，寒邪内侵，饮食不节，久病过劳也是冠心病心绞痛的一部分病因（C错）。风湿性心脏瓣膜病的发生与饮食关系不大（D错）。寒邪内侵，饮食不节，情志失调，年迈体衰，痰湿内蕴是冠心病心绞痛的中医病因（E错）。